下列哪种不是实验流行病学研究方法
A. 临床试验
B. 现场试验
C. 病例对照
D. 社区试验

正确答案：C。病例对照

解析：本题考查实验流行病学研究方法。实验流行病学根据研究目的和研究对象不同可分为临床试验（A对）、现场试验（B对）、社区试验（D对）。病例对照研究（C错，为本题正确答案）属于分析性流行病学。